临床上急性根尖周炎的哪一阶段疼痛达到最高峰
A. 急性浆液性根尖周炎
B. 急性根尖周脓肿
C. 急性骨膜下脓肿
D. 急性黏膜下脓肿
E. 致密性骨炎

正确答案：C。急性骨膜下脓肿

解析：本题考查急性化脓性根尖周炎-骨膜下脓肿。临床上急性根尖周炎发展到急性骨膜下脓肿（C对）时，因骨膜坚韧、致密，脓液集聚于骨膜下所产生的压力很大，神经受压，病程至此疼痛达到最高峰。急性浆液性根尖周炎（A错）一般无自发痛或只有轻微钝痛，有时患者还可诉有咬紧患牙反而稍感舒服的症状，这是因为咬合的压力可暂时缓解局部血管的充血状态，使根尖周膜因组织水肿所形成的压力得到减轻。急性根尖周炎发展到急性根尖周脓肿（B错）时，患牙出现自发性、剧烈持续的跳痛，伸长感加重，以至咬合时首先接触患牙并引起剧痛，患者因而不敢咬合，疼痛未达到最高峰。急性根尖周炎发展到急性黏膜下脓肿（D错）时，由于黏膜下组织较疏松，脓液到达黏膜下时，压力已大为减低，自发性胀痛及咬合痛也随之减轻。致密性骨炎（E错）属于慢性根尖周炎，一般无明显的自觉症状，有时患牙可在咀嚼时有不适感。